男，75岁。慢性阻塞性肺疾病急性加重反复出现，抗感染治疗时，为覆盖铜绿假单胞菌，下列抗菌药物中宜首选的是
A. 莫西沙星
B. 阿米卡星
C. 头孢他啶
D. 阿奇霉素
E. 阿莫西林

正确答案：C。头孢他啶

解析：患者老年男性，慢性阻塞性肺疾病急性加重反复出现，抗感染治疗时，为覆盖铜绿假单胞菌（铜绿假单胞菌感染），第三代头孢菌素能有效控制严重的铜绿假单孢菌感染，第三代头孢菌素有头孢噻肟、头孢唑肟、头孢曲松、头孢地秦、头孢他定（C对）、头孢哌酮等。莫西沙星（A错）喹诺酮类抗菌药，重要用于敏感菌所致的慢性支气管炎急性发作、社区获得性肺炎、急性鼻窦炎等的治疗（P399）。阿米卡星（B错）是氨基糖苷类抗生素，常作为耐氨基糖苷类菌株所致感染的首选药物（P388）。阿奇霉素（D错）是大环内酯类抗生素，大环内酯类主要用于链球菌、军团菌、衣原体、支原体感染等（P380）。阿莫西林（E错）是青霉素类抗生素，主要用于敏感菌所致的呼吸道、尿路、胆道感染以及伤寒治疗（P374）。